在下腹部，前正中线上，当脐中下3寸的穴位为
A. 三阴交
B. 中极
C. 关元
D. 石门
E. 气海

正确答案：C。关元

解析：关元前正中线上，脐下3寸（C对 ）。三阴交位于内踝尖上3寸，胫骨内侧面后缘（A错）。中极位于前正中线上，脐下4寸（B错）。石门位于前正中线上，脐下2寸（D错）。气海位于前正中线上，脐下1.5寸（E错）。